生成酮体的原料是
A. β-羟丁酸
B. 乙酰CoA
C. 丙酮
D. 辅酶A
E. 酮体酶

正确答案：B。乙酰CoA

解析：酮体的生成以乙酰CoA为原料，在肝线粒体经酶催化，先缩合、再裂解，生成酮体。掌握“脂肪的分解代谢”知识点。